镜下见肿物内牙体组织成分排列紊乱，相互混杂，而无典型的牙结构，为以上哪种疾病的病理表现
A. 多形性腺瘤
B. 混合性牙瘤
C. 良性黏膜类天疱疮
D. 组合性牙瘤
E. 根尖囊肿

正确答案：B。混合性牙瘤

解析：混合性牙瘤：镜下见肿物内牙体组织成分排列紊乱，相互混杂，而无典型的牙结构。发育期的混合性牙瘤，与成釉细胞纤维瘤或成釉细胞纤维-牙瘤不易区别。掌握“牙瘤”知识点。